某县城有6所小学，5所初中和3所高中：所属乡镇有10所中心小学，24所村小学和6所初中。该县疾病预防控制中心学校卫生科为了观察本县学生的生长发育动态拟开展调查。应组织开展
A. 现况调查
B. 队列研究
C. 健康监测
D. 半纵向调查
E. 追踪性调查

正确答案：C。健康监测